女，28岁。因肺结核咯血入院，1小时前又咯血约60ml，现在病人感胸闷气促，咯血不畅，继之两手乱抓，不能说话，张口瞪目。应采取的抢救措施是
A. 口对口人工呼吸
B. 高压给氧
C. 垂体后叶素静脉推注
D. 检查口腔并清除血凝块
E. 使呈头低足高位，拍背

正确答案：E。使呈头低足高位，拍背

解析：青年女性，因肺结核咯血入院（肺结核咯血病史），1小时前又咯血约60ml，现在病人感胸闷气促，咯血不畅（咯血后出现的临床症状，咯血不畅提示呼吸道堵塞），继之两手乱抓，不能说话，张口瞪目（提示患者出现急性阻塞性呼吸困难的症状）。综合该患者的病史、症状，考虑为咯血引起的窒息。应采取的抢救措施是使起呈头低足高位，拍背（E对）。这一措施操作简便快捷，有利于迅速排出血凝块，通畅呼吸道。口对口人工呼吸（A错）是CPR抢救中重要的操作步骤，对于失去自主呼吸病人的抢救有重要意义，但对于呼吸道已存在阻塞的病人并无作用。高压给氧（B错）常用于低氧血症病人的抢救，但对于呼吸道已存在阻塞的病人并无作用。垂体后叶素静脉推注（C错）可以收缩小动脉，使肺循环血量减少而达到较好止血效果，常用于肺结核大咯血的抢救，但此时需要抢救的是病人呼吸困难的症状，故不选垂体后叶素静脉推注。检查口腔并清除血凝块（D错）并不能起到通畅呼吸道的作用，对于解决呼吸道阻塞的问题没有帮助。